下列各项，可见口干但欲漱水不欲咽症状的是
A. 湿热
B. 阴虚
C. 痰饮
D. 瘀血
E. 温病营分证

正确答案：D。瘀血

解析：湿热证因热邪伤津口渴，体内有湿故见渴不多饮，并兼见湿热的临床表现（A错）。阴虚则内热，阴不足则失于滋润，故见口渴咽干（B错）。痰饮内阻，津液不能气化上承于口，故口渴，痰饮属阴，故喜热饮，体内有饮邪，故不多饮或水入即吐（C错）。瘀血内阻津液失于输布，故口干，体内津液本不亏乏，故但欲漱水不欲咽（D对）。温病营分证，因热邪耗伤阴津而见口渴，热邪蒸腾营阴上潮于口，故不多饮（E错）。